有关酶原激活的概念，正确的是
A. 初分泌的酶原即有酶活性
B. 酶原转变为酶是可逆反应过程
C. 无活性酶原转变为有活性酶
D. 酶原激活无重要生理意义
E. 酶原激活是酶原蛋白质变性

正确答案：C。无活性酶原转变为有活性酶

解析：酶原激活是无活性的酶原转变成有催化活性的酶，实际上是酶的活性中心形成或暴露的过程。但是此过程不可逆，而且有重要的生理意义，在消化器官中以酶原的形式存在可以保护消化器官不受酶本身的水解破坏，而且保证酶在特定的部位与环境发挥其催化作用，此外酶原还可以看成是酶的贮存形式。掌握“酶活性调节（抑制与激活）”知识点。